不属于我国计划免疫范畴的传染病是
A. 乙肝
B. 风疹
C. 麻疹
D. 脊髓灰质炎
E. 结核病

正确答案：B。风疹